腓总神经受损则
A. 足不能外翻和背屈
B. 足底皮肤感觉丧失
C. 足不能跖屈
D. 小腿内侧皮肤感觉障碍
E. 不能屈趾

正确答案：A。足不能外翻和背屈

解析：腓总神经受损后表现为足不能背屈，趾不能伸（A对），足下垂且内翻，呈“马蹄内翻足”畸形,行走时呈“跨阈步态”，同时小腿前、外侧面及足背区出现明显的感觉障碍。胫神经损伤导致足底皮肤感觉丧失（B错），足不能跖屈（C错）。